具有全自动、半自动清洗设备的是
A. 手工清洗
B. 清洗机清洗
C. 超声波清洗
D. 消毒
E. 灭菌

正确答案：B。清洗机清洗

解析：清洗机清洗：有全自动、半自动清洗器和专用设备清洗器。这些清洗器一般包括冷水清洗、洗涤剂清洗、漂洗、最后热水消毒（水温为80～90℃，至少可达中等水平消毒）和干燥过程。掌握“口腔器械的消毒与灭菌及医疗废物处理”知识点。